病理表现为炎症四处扩散，中性粒细胞广泛浸润至整个牙髓组织，形成多处小脓肿，髓腔压力增加，可引起牙髓液化坏死的是
A. 急性牙周脓肿
B. 急性增生性牙髓炎
C. 急性化脓性牙髓炎
D. 急性浆液性根尖周炎
E. 急性浆液性牙髓炎

正确答案：C。急性化脓性牙髓炎

解析：急性牙髓炎后期炎症迅速向周围扩散，中性粒细胞广泛浸润至整个牙髓组织，形成多处小脓肿，此时，若炎性渗出未得到及时引流，髓腔压力极度增加，最终使整个牙髓液化坏死，此时称为急性化脓性牙髓炎。掌握“急、慢性牙髓炎”知识点。